衣服面料在使用之前通过什么方法可以减少甚至排除甲醛对机体的不利影响
A. 晾晒
B. 干洗
C. 用水洗涤
D. 拍打
E. 加强机体防护

正确答案：C。用水洗涤

解析：本题考查衣服面料在使用之前可以减少甚至排除甲醛对机体的不利影响的方法。由于甲醛易溶于水，因此衣服面料在使用之前通过洗涤（C对ABDE错）可以减少甚至排除甲醛对机体的不利影响。